女，40岁，反复膀胱刺激征伴低热1年，尿常规：PH5.5，蛋白微量，WBC20-30，RBC20-30，血沉增高，CT示双肾斑片状钙化，最可能诊断
A. 肾肿瘤
B. 肾结核
C. 肾结石合并感染
D. 输尿管结石
E. 尿路感染

正确答案：B。肾结核

解析：该患者女，40岁（肾结核的好发年龄），出现反复膀胱刺激征伴低热（肾结核的表现），血沉增高，CT示双肾斑片状钙化（肾结核的影像学表现），结合患者的年龄，表现和辅助检查，最可能的诊断是肾结核（B对）。